上牙槽后神经阻滞麻醉时刺破翼静脉丛引起血肿，可能是由于
A. 注射点过低
B. 针尖刺入过深
C. 针尖刺入过前
D. 针尖刺入过后
E. 麻药注射入血管内

正确答案：B。针尖刺入过深

解析：本题考查局部麻醉并发症及防治。注意针尖刺入不宜过深（B对），以免刺破上颌结节后方的翼静脉丛，引起血肿。注射针刺破血管所致，较常见于上牙槽后神经、眶下神经阻滞麻醉时。特别在刺伤静脉丛后，可发生组织内出血，在黏膜下或皮下出现紫红色瘀斑或肿块。数日后，血肿处颜色逐渐变浅呈黄绿色，并缓慢吸收消失。